休克初期微循环灌流的特点是：
A. 多灌少流，灌多于流
B. 少灌少流，灌少于流
C. 少灌多流，灌少于流
D. 多灌多流，灌多于流
E. 多灌多流，灌少于流

正确答案：B。少灌少流，灌少于流

解析：少灌少流，灌少于流（B对），组织呈缺血缺氧状态是休克初期（微循环缺血性缺氧期）组织微循环灌流的特点。多灌少流，灌多于流（A错）是休克II期微循环灌流的特点。